医务人员共同的首要义务和天职是
A. 维护病人的利益和社会公益
B. 维护医务人员和医院的声誉
C. 维护医务人员和医院的经济效益
D. 维护医务人员和医院的自身利益
E. 维护医务人员之间、医院间的和谐

正确答案：A。维护病人的利益和社会公益

解析：大公无私是医德境界的最高层次，其主要特点是：医务人员把有利于病人、集体和社会作为职业行为准则，自觉坚持，持之以恒；凡事先为病人、集体和社会着想，把共同维护病人的利益和社会公益（A对）作为自己的天职。